对病原菌尚未明确的化脓性脑膜炎晚期新生患儿，首选的抗生素是
A. 氯霉素+头孢曲松
B. 庆大霉素+头孢克肟
C. 万古霉素+头孢曲松
D. 阿奇霉素+头孢克肟
E. 青霉素+头孢克肟

正确答案：C。万古霉素+头孢曲松

解析：对病原菌尚未明确的化脓性脑膜炎晚期新生患儿，首选的抗生素是万古霉素+头孢曲松（C对），氯霉素+头孢曲松（A错）是流感嗜血杆菌感染的首选抗生素。青霉素+头孢克肟（E错）是脑膜炎球菌的首选抗生素。